紫杉醇（Taxol）是从美国西海岸的短叶红豆杉的树皮中提取得到的具有紫杉烯环结构的二萜类化合物，属有丝分裂抑制剂或纺锤体毒素。多西他赛（Docetaxel）是由10-去乙酰基浆果赤霉素进行半合成得到的紫杉烷类抗肿瘤药物，结构上与紫杉醇有点不同，一是第10位碳上的取代基，二是3′位上的侧链。多西他赛的水溶性比紫杉醇好，毒性较小，抗肿瘤谱更广。紫杉醇注射液中通常含有聚氧乙烯蓖麻油，其作用是
A. 助悬剂
B. 稳定剂
C. 等渗调节剂
D. 增溶剂
E. 金属螯合剂

正确答案：D。增溶剂

解析：本题考查紫杉醇注射液中辅料的作用。紫杉醇注射液中通常含有聚氧乙烯蓖麻油，其作用是增溶剂（D对）。增溶是指难溶性药物在表面活性剂的作用下，在溶剂中增加溶解度并形成溶液的过程。紫杉醇的水溶性较小，因此在其注射剂中通常加入表面活化剂聚氧乙烯蓖麻油助溶，增加其溶解性。助悬剂（A错）是指能增加混悬剂中分散介质的黏度，降低药物微粒的沉降速度或增加微粒亲水性的附加剂。稳定剂（B错）是在混悬剂中起润湿、助悬、絮凝或反絮凝作用的附加剂。等渗调节剂（C错）是指可以调节溶液的渗透压与人体血液的渗透压相等的物质。金属螯合剂（E错）常用来络合金属离子，防止药品被氧化，如乙二胺四乙酸。